某患儿，5岁，先天Ⅲ°腭裂，在全麻下接受腭裂修复术，为使发音和讲话接近正常，术后应
A. 进行语音训练
B. 长期配戴腭护板
C. 调整饮食习惯
D. 正畸矫治错（牙合）
E. 局部理疗

正确答案：A。进行语音训练

解析：本题考查腭裂的个性化序列治疗。患儿，5岁，先天Ⅲ°腭裂（全腭裂开），在全麻下接受腭裂修复术，为使发音和讲话接近正常（腭裂语音），目前腭裂术后有异常语音者仍不可避免，术后应进行语音训练（A对），纠正各种代偿发音造成异常语音者。长期配戴腭护板（B错）多用于唇腭裂患儿的术前正畸，在患儿适应腭护板后，在腭护板上制作鼻撑球，用鼻撑来纠正鼻畸形。正畸矫治错牙合（D错）在上下颌第一磨牙萌出后根据患者个体发育情况进行错牙合预防处理，主要于恒牙期进行矫治。调整饮食习惯（C错）和局部理疗（E错）与发音和讲话没有明显联系。